患者男，31岁，患风湿性心脏病二尖瓣狭窄伴关闭不全4年，半年前骤发心悸，心电图示快速房颤，经洋地黄治疗，心率减慢目前心率75次/分，心率仍绝对不规则，血沉与抗“O”低度正常。首选的治疗措施是
A. 药物或电击复率
B. 地高辛加糖皮质激素
C. 继续用地高辛控制心率
D. 停用洋地黄
E. 地高辛加用心得安治疗

正确答案：C。继续用地高辛控制心率

解析：地高辛是洋地黄类的强心药，它可以增强心脏的收缩力、延缓房室传导、减慢心率，治疗房颤（C对D错）。心房颤动病程＜1年，左房直径＜60mm、无高度或完全性房室传导阻滞和病态窦房结综合征者，可行选择性电复律或药物转复（A错）。风心病防止风湿热复发，积极防治猩红热、急性扁桃体炎、咽炎等链球菌感染，目前患者无感染指征，故暂不用糖皮质激素（B错）。心得安用于治疗多种原因所致的心律失常，可以降低心律，但目前患者心率75次/分，属于正常范围（E错）。